生后9个月开始
A. 发出喉音
B. 咿呀发音
C. 能懂“再见”
D. 开始用单词
E. 能说出自己的名字

正确答案：C。能懂“再见”

解析：7～8个月能无意识发出复音，如“爸爸”、“妈妈”，9个月能听懂“再见”等。掌握“运动和语言发育”知识点。